导致输卵管妊娠的主要原因是
A. 剖宫产史
B. 输卵管发育不良或功能异常
C. 输卵管妊娠史
D. 子宫肌瘤
E. 输卵管炎症

正确答案：E。输卵管炎症

解析：输卵管发育不良或功能异常、输卵管妊娠史、子宫肌瘤、输卵管炎症均是输卵管妊娠的病因，但主要病因是输卵管炎症（E对）。剖宫产史不是输卵管妊娠的病因（A错）。